医生告知某患者患有糖尿病并且让其接受药物治疗，但该患者并不相信自己患病，未听从医生的医嘱服药而是继续上班。该患者的角色行为类型属于
A. 角色行为转化
B. 角色行为缺如
C. 角色行为强化
D. 角色行为异常
E. 角色行为冲突

正确答案：B。角色行为缺如

解析：角色适应不良包括角色行为缺如、角色行为冲突、角色行为减退、角色行为强化、角色行为异常。病人未能进入病人角色，不承认自己是病人，这种角色行为的改变属于角色行为缺如（B对）。角色行为减退是个体进入病人角色后，由于某种原因又重新承担起本应免除的社会角色的责任，放弃了病人角色去承担其他角色的活动。角色行为强化（C错）是随着躯体的康复，病人角色行为也应转化为正常的社会角色行为。角色行为异常（D错）是病人无法承受患病或不治之症的挫折和压力，对病人角色感到厌倦、悲观、绝望，由此导致行为异常。角色行为冲突（E错）是当多种社会地位和多种角色集于一人时，在其自身内部产生的冲突。